下列不是出生至18个月婴幼儿教育重点的是
A. 预防接种
B. 母乳喂养
C. 智力开发
D. 传染病预防
E. 先天缺陷的筛查

正确答案：D。传染病预防